子痫发作时孕妇的直接死因是
A. 心脏病
B. 脑出血
C. Ⅲ度胎盘早剥
D. 急性重型肝炎
E. 急性肾功能衰竭

正确答案：B。脑出血

解析：子痫的基本病理生理变化为全身小血管痉挛，内皮细胞损伤及局部缺血。脑血管痉挛，其通透性增加，出现脑水肿、脑出血（B对）等脑血管意外，是子痫发作时孕妇的直接死亡原因。心脏病（A错）、急性重型肝炎（D错）、急性肾功能衰竭（E错）虽能导致患者死亡，但与子痫发作没有关系。Ⅲ度胎盘早剥（C错）可由子痫引起，并导致孕妇死亡，但孕妇的直接死亡原因常为胎盘早剥的并发症，如弥散性血管内凝血、产后出血、急性肾衰竭、羊水栓塞等。